龋病的定义是
A. 牙齿在多种因素的影响下，其组织发生的一种慢性进行性破坏性疾病
B. 多种生物因素的共同作用下，牙齿硬组织发生急性严重性破坏的一种病变
C. 在以细菌为主的多种因素影响下，牙齿硬组织发生慢性进行性破坏的一种疾病
D. 在多种内在因素的影响下，牙齿硬组织发生慢性进行性破坏的一种疾病
E. 在细菌影响下，牙齿硬组织发生慢性进行性破坏的一种疾病

正确答案：C。在以细菌为主的多种因素影响下，牙齿硬组织发生慢性进行性破坏的一种疾病

解析：龋病是在以细菌为主的多种因素作用下，牙体硬组织发生的慢性、进行性破坏的一种疾病。掌握“龋病概述”知识点。